下列哪项不是急性白血病痰热瘀阻证的表现
A. 心烦口苦
B. 腹部癥积
C. 舌质紫暗
D. 口渴喜饮
E. 痰多胸闷

正确答案：D。口渴喜饮

解析：痰热瘀阻于腹部，故可见腹部癥积（B对）；痰热瘀阻，气机不畅，故可见痰多胸闷（E对）、舌质紫暗（C对）；痰热上扰，故可见心烦口苦（A对）。痰热瘀阻，尚未伤及体内津液，仅致津不上承，故多见口渴而不欲饮（D错，为本题正确答案）。治法宜清热化痰，活血散结，宜选用温胆汤合桃红四物汤加减。